功能祛风解表、透疹消疮的药物是
A. 麻黄
B. 桂枝
C. 紫苏
D. 生姜
E. 荆芥

正确答案：E。荆芥

解析：本题考查的是荆芥的功效。功能祛风解表、透疹消疮的药物是荆芥（E对）。荆芥：【功效】散风解表，透疹止痒，止血。【主治病证】（1）风寒表证，风热表证。（2）麻疹透发不畅，风疹瘙痒。（3）疮疡初起有表证者。（4）（荆芥炭）衄血，吐血，便血，崩漏等证。麻黄（A错）：【功效】发汗解表，宣肺平喘，利水消肿。桂枝（B错）：【功效】发汗解肌，温通经脉，助阳化气。紫苏（C错）：【功效】发表散寒，行气宽中，安胎，解鱼蟹毒。生姜（D错）：【功效】发汗解表，温中止呕，温肺止咳。